被测药物与滴定剂的摩尔比为：用亚硝酸钠滴定法测定磺胺嘧啶的含量
A. 1∶1
B. 1∶2
C. 1∶3
D. 1∶4
E. 3∶2

正确答案：A。1∶1